新生儿期筛查苯丙酮尿症最常用的实验室方法为
A. 尿三氯化铁试验
B. DNA分析
C. 尿2，4-二硝基苯肼试验
D. Guthrie细菌抑制试验
E. 染色体核型分析

正确答案：D。Guthrie细菌抑制试验